“虚”的病机主要是指
A. 卫气不固
B. 正气虚损
C. 脏腑功能低下
D. 气血生化不足
E. 气化无力

正确答案：B。正气虚损

解析：虚证是指正气不足，以正气虚损为矛盾主要方面的一种病理变化（B对）。即机体的正气虚弱，防御能力和调节能力低下，对于致病邪气的斗争无力，而邪气已退或不明显，故难以出现邪正斗争剧烈的病理反应，临床表现一系列虚弱如气化不足（E错）、衰退如脏腑功能低下（C错）和不足如气血生化不足（D错）的证候，称为虚证。另外卫气不固是外感汗出的病机（A错）。